当归炒炭能起到
A. 增强活血调经的作用
B. 增强活血补气的作用
C. 补血又不致滑肠的作用
D. 增强润肠通便的作用
E. 止血和血的作用

正确答案：E。止血和血的作用

解析：本题考查的是当归的炮制作用。当归炒炭能起到止血和血的作用（E对）。当归：【炮制作用】当归味甘、辛、性温。归肝、心、脾经。①生品质润，具有补血，调经，润肠通便的功能。传统习惯止血用当归头，补血用归身，破血用当归尾，补血活血用全当归。当归生用还可用于血虚萎黄，眩晕心悸，月经不调，肠燥便秘，痈疽疮疡。②酒炙当归，增强活血通经、祛瘀止痛的作用（A错）。用于经闭痛经，风湿痹痛，跌打损伤，瘀血肿痛。③土炒当归，既能增强入脾补血作用，又能缓和油润而不滑肠（C错）。可用于治疗血虚便溏，腹中时痛。④当归炭，具有止血和血作用。用于崩中漏下，月经过多。炮制后增强活血补气的作用（B错）或增强润肠通便的作用（D错）的中药，2022年考试指南未明确说明。